单纯餐后血糖升高，空腹与餐前血糖水平不高患者应选用
A. 双胍类
B. α-葡萄糖苷酶抑制剂
C. 磺酰脲类
D. 胰岛素与胰岛素类似物
E. 血管紧张素转换酶抑制剂

正确答案：B。α-葡萄糖苷酶抑制剂

解析：本题考查降糖药。单纯餐后血糖升高，空腹与餐前血糖水平不高患者应选用α-葡萄糖苷酶抑制剂（B对）。二甲双胍（A错）是治疗2型肥胖型糖尿病患者的首选。促胰岛素分泌剂（磺酰脲类（C错）和格列奈类）用于有良好的胰岛β细胞储备功能、无高胰岛素血症的2型非肥胖型糖尿病患者。胰岛素（D错）用于1型糖尿病。血管紧张素转换酶抑制剂（E错）用于高血压。